关节囊内有韧带的关节是
A. 肩关节
B. 肘关节
C. 胸锁关节
D. 踝关节
E. 髋关节

正确答案：E。髋关节

解析：髋关节（E对）关节囊内有股骨头韧带，内含营养股骨头的血管。